根据《中华人民共和国药品管理法实施条例》的规定，包装不符合规定的中药饮片，生产企业
A. 必须没收
B. 必须销毁
C. 不得使用
D. 不得销售
E. 限制销售

正确答案：D。不得销售

解析：本题考查中药饮片销售管理。根据《中华人民共和国药品管理法实施条例》的规定，包装不符合规定的中药饮片，生产企业不得销售（D对）。《药品管理法实施条例》规定：“生产中药饮片，应当选用与药品性质相适应的包装材料和容器；包装不符合规定的中药饮片，不得销售”。